处方名延胡索，调剂时应付
A. 煅制品
B. 蜜炙品
C. 醋制品
D. 盐制品
E. 烫制品

正确答案：C。醋制品

解析：本题考查的是常见的处方应付实例。处方名延胡索，调剂时应付醋制品（C对）。常见的处方应付实例：（1）处方直接写药名（或炒），需调配清炒品，如紫苏子、莱菔子、谷芽、麦芽、王不留行、酸枣仁、蔓荆子、苍耳子、牛蒡子、白芥子等。（2）处方直接写药名（或炒），需调配麸炒品，如僵蚕、白术、枳壳等。（3）处方直接写药名（或制），需调配炮制品，如草乌（水制）、川乌（水制）、天南星（矾制）、附子（炮制）、吴茱萸（甘草水制）、远志（甘草水制去心）、厚朴（姜制）、何首乌等。（4）处方直接写药名（或炒或炙），需调配烫制品（E错），如龟甲、鳖甲、穿山甲等。（5）处方直接写药名（或煅），需调配煅制品（A错），如花蕊石、钟乳石、自然铜、金礞石、青礞石、瓦楞子等。（6）处方直接写药名（或炒或炭），需调配炭制品，如干漆、炮姜、地榆、侧柏叶、蒲黄等。（7）处方直接写药名（或炒或炙），需调配蜜炙品（B错），如枇杷叶、马兜铃等。（8）处方直接写药名（或炒或炙），需调配醋炙品，如延胡索等。（9）处方直接写药名（或炒或炙），需调配盐炙品（D错），如补骨脂、益智仁等。